女，35岁。外阴瘙痒伴烧灼伤感2天。妇科检查：外阴局部充血，阴道黏膜表面有白色凝乳状物覆盖，阴道分泌物镜检找到假菌丝。该患者首选治疗药物是
A. 糖皮质激素
B. 甲硝唑
C. 雌激素
D. 制霉菌素
E. 干扰素

正确答案：D。制霉菌素

解析：患者女，35岁。外阴瘙痒伴烧灼伤感2天。妇科检查：外阴局部充血，阴道黏膜表面有白色凝乳状物覆盖，阴道分泌物镜检找到假菌丝。诊断为外阴阴道假丝酵母菌病。单纯性VVC的治疗，局部用药：可用制霉菌素栓剂（D对）